库瓦济埃征阳性应考虑为
A. 胆囊炎
B. 胆石症
C. 肝脓肿
D. 胰头癌
E. 溶血性贫血

正确答案：D。胰头癌

解析：库瓦济埃征（Courvoisier征）是胰头癌（D对）压迫胆总管导致阻塞时，发生明显黄疸，且逐渐加深，胆囊显著肿大，但无压痛，是诊断胰腺癌的重要体征。胆囊炎（A错）可有墨菲征阳性；胆石症（B错）可发生黄疸，但胆囊常不肿大，呈库瓦济埃征（Courvoisier征）阴性；肝脓肿（C错）查体可表现为肝压痛和肿大；溶血性贫血（E错）可有脾大。